关于医德情感，正确的说法是
A. 它与医德义务无关
B. 它以医务人员个人的需要为前提
C. 它应能满足病人的一切需要
D. 它是医务人员的盲目冲动
E. 它是医务人员内心体验的自然流露

正确答案：E。它是医务人员内心体验的自然流露